引起尿路感染的病原体最多见的是
A. 葡萄球菌
B. 变形杆菌
C. 副大肠埃希菌
D. 大肠埃希菌
E. 链球菌

正确答案：D。大肠埃希菌

解析：革兰阴性杆菌为尿路感染的常见致病菌，其中最常见的为大肠埃希菌（D对C错），约占全部尿路感染的85%，其次为克雷伯杆菌、变形杆菌（B错）、柠檬酸杆菌。葡萄球菌见于血源性尿路感染，较少见（A错）。链球菌引起尿路感染者少见（E错）。